关于酊剂、药酒的叙述，正确的是
A. 酊剂与药酒制备时所用溶剂均为乙醇
B. 酊剂与药酒通常均可用渗漉法、稀释法、溶解法制备
C. 含毒性药品的酊剂每100ml相当于原药材20g
D. 药酒每1ml相当于原药材2-5g
E. 酊剂与药酒的成品均应测定含醇量

正确答案：E。酊剂与药酒的成品均应测定含醇量